某搬运工人从山下搬重物上山，劳动时氧需超过氧上限，该工人从事的劳动强度属于
A. 中等强度作业
B. 大强度作业
C. 极大强度作业
D. 超强度作业
E. 轻强度作业

正确答案：B。大强度作业